下列关于胃的说法中，何者是错误的
A. 是消化管中最膨大的部分
B. 有两壁、两缘和两口
C. 胃小弯的最低点叫角切迹
D. 贲门位置基本固定
E. 胃大弯在人直立时不会低于髂嵴平面

正确答案：E。胃大弯在人直立时不会低于髂嵴平面

解析：胃是消化管中最膨大的部分(A对)，有两壁、两缘和两口(B对)，胃小弯最低点有一明显转折处叫角切迹(C对)，胃贲门的位置基本固定(D对)，胃大弯一般在脐平面，在高度充盈时可低于髂嵴平面(E错，为本题正确答案)。